鹿茸中具有促进核酸和蛋白质合成作用的有效成分是
A. 肽类
B. 胆甾醇类
C. 多胺类
D. 氨基酸类
E. 脂肪酸类

正确答案：C。多胺类

解析：本题考查的是鹿茸的有效成分。鹿茸中具有促进核酸和蛋白质合成作用的有效成分是多胺类（C对）。鹿茸中多胺类精眯、精胺、腐胺对化合物是刺激核酸和蛋白质合成的有效成分。